下列有关婴儿期心理发育特征的描述有哪一项是不正确的
A. 心理发展从粗大运动、言语、精细动作等开始逐步扩展到社会性发展，形成有目的的记忆
B. 动作的发育从孤立运动到共济协调，逐步实现力量、速度、方向、平衡、协调等方面能力的提高
C. 新生儿一出生就表现出有明显而稳定特征的个人气质
D. 了解婴儿的气质及其类型，对预测其未来的个性发展有重要意义
E. 依恋是婴幼儿获得安全感的基础

正确答案：A。心理发展从粗大运动、言语、精细动作等开始逐步扩展到社会性发展，形成有目的的记忆